对患者死因有异议的，应在48小时内进行尸检，具备冷冻条件的可以延长至
A. 3天
B. 4天
C. 5天
D. 6天
E. 7天

正确答案：E。7天

解析：患者死亡，医患双方当事人不能确定死因或者对死因有异议的，应当进行尸检。尸检必须在患者死亡后48小时内进行，但具备尸体冻存条件的可以延长至7日。掌握“医疗事故处理概述、预防与处置”知识点。